色谱法常用术语中，tR代表的量是
A. 分配系数
B. 容量因子
C. 保留时间
D. 峰宽
E. 半高峰宽

正确答案：C。保留时间

解析：本题考查色谱法。色谱法常用术语中，tR代表的量是保留时间（C对）。保留时间是溶质因与固定相作用在色谱柱中所停留的时间。通常用tR表示。分配系数（A错）用K表示。容量因子（B错）用k´表示。峰宽（D错）用W表示。半高峰宽（E错）用W1/2表示。